危险度管理中依据的主要是
A. 毒理学试验
B. 危险度评定
C. LD₅₀
D. NOAEL
E. 基准剂量

正确答案：B。危险度评定